右上第一磨牙龋损窝洞制备时，鸠尾峡宽度一般为
A. 颊舌牙尖间距的1/4
B. 颊舌牙尖间距的1/4～1/3
C. 颊舌牙尖间距的1/3～1/2
D. 颊舌牙尖间距的1/2～2/3
E. 颊舌牙尖间距的2/3～3/4

正确答案：B。颊舌牙尖间距的1/4～1/3

解析：窝洞制备：鸠尾峡的宽度一般在后牙为所在颊舌尖间距的1/4～1/3；鸠尾峡的位置应在轴髓线角的内侧。嵌体制备：鸠尾峡部的宽度一般不大于（牙合）面的1/2。掌握“银汞充填窝洞的概念”知识点。